续发率的用途不包括
A. 比较不同传染病相对传染力的大小
B. 比较家庭大小对传染病传播的影响
C. 比较不同经济卫生条件对传染病传播的影响
D. 评价防疫措施的效果
E. 病因不明疾病的病因调查

正确答案：E。病因不明疾病的病因调查

解析：本题考查续发率的用途。续发率是反映传染病传染力强弱（A对）的指标，可用于分析传染病流行因素，包括不同因素对传染病传播的影响，如年龄、性别、家庭中儿童数、家庭人口数（B对）、经济条件（C对）等对传播的影响；可用来评价卫生防疫措施的效果（D对），如对计划免疫、隔离、消毒等措施的评价。续发率不能调查病因不明的疾病（E错，为本题正确答案）。